异烟肼的作用特点有
A. 结核杆菌不易产生抗药性
B. 对细胞外的结核杆菌有效
C. 对细胞内的结核杆菌无效
D. 治疗中引起维生素B₆缺乏
E. 与对氨基水杨酸合用，两者均在肝脏乙酰化，从而提高疗效

正确答案：B、D、E。对细胞外的结核杆菌有效；治疗中引起维生素B₆缺乏；与对氨基水杨酸合用，两者均在肝脏乙酰化，从而提高疗效

解析：本题考查异烟肼的作用特点。异烟肼对结核分枝杆菌具有高度抗菌作用，对繁殖期和静止期细菌均有强大杀灭作用，且不受环境pH的影响，对细胞内外结核菌都能杀灭（B对C错）。结核菌对异烟肼易产生耐药性（A错），与对氨水杨酸等药合用时，可以提高疗效，降低毒性，延缓耐药性的发生（E对）。异烟肼为维生素B₆的拮抗剂，可增加维生素B₆经肾排出量，易致周围神经炎的发生（D对）。同时服用维生素B₆者，需酌情增加用量。